创立了以阴阳为主的辨证论治法则的是
A. 汪机
B. 高锦庭
C. 陈实功
D. 王洪绪
E. 吴师机

正确答案：D。王洪绪

解析：王洪绪即是王维德，其主要学术思想为阴虚阳实论，创立了外科证治中以阴阳为核心的辨证论治法则（D对）。汪机的《外科理例》，主张外科病治疗以消为贵，以托为畏，并首创玉真散治疗破伤风（A错）。高锦庭首先将温病学说引入外科证治，用三焦辨证揭示了外科病因与发病部位的规律（B错）。陈实功以《外科正宗》为代表，被评价为列证最详，论治最精，对中医外科学的发展影响很大（C错）。吴师机以《理瀹骈文》为代表，该书集外治法之大成，主张以外治法通治内、外诸病（E错）。